受理申请医师注册的卫生行政部门对不符合条件不予注册的，应当自收到申请之日起多少工作日内给予申请人书面答复，并说明理由
A. 15日
B. 20日
C. 30日
D. 40日
E. 45日

正确答案：B。20日

解析：受理申请医师注册的卫生行政部门对不符合条件不予注册的，应当自收到申请之日起20个工作日（B对）内给予申请人书面答复，并说明理由。申请人如有异议的，可以依法申请行政复议或者向人民法院提起行政诉讼。